在五腧穴中，输穴主治
A. 喘咳寒热
B. 逆气而泄
C. 身热
D. 心下满
E. 体重节痛

正确答案：E。体重节痛

解析：《灵枢·顺气一日分为四时》云：“病在脏者，取之井；病变于色者，取之荥；病时间时甚者，取之输；病变于音者，取之经；经满而血者，病在胃及以饮食不节得病者，取之于合”。《难经·六十八难》做了补充：“井主心下满，荥主身热，输主体重节痛（E对），经主喘咳寒热，合主逆气而泄”。综合现代临床的应用情况，井穴多用于急救，荥穴主要用于治疗热证，输穴多主脏病，经穴多主经脉循行部位痛证，合穴多主腑病。